可引起高度脾肿大的疾病是
A. 慢性粒细胞性白血病
B. 系统性红斑狼疮
C. 败血症
D. 慢性肝炎
E. 肝硬化

正确答案：A。慢性粒细胞性白血病

解析：慢性粒细胞性白血病（A对）是一种发生在多能造血干细胞的恶性骨髓增生性肿瘤，病程缓慢，主要表现为脾脏显著肿大，往往就医时已达脐或脐以下，质地坚实，平滑，无压痛。系统性红斑狼疮（B错）是一种多系统损害的慢性自身免疫性疾病，临床表现多样，可出现全身、皮肤黏膜、肌肉关节、肾、心血管、肺、神经系统、消化系统及血液系统等多系统损害症状，累及血液系统时仅有少数患者表现为脾大；败血症（C错）是指致病菌侵入血循环，产生毒素发生的急性全身性感染，主要表现为畏寒寒战、高热、皮疹及关节痛等，可有轻度肝脾大，各种不同致病菌引起的败血症又有其不同的临床特点；慢性肝炎（D错）早期症状轻微且缺乏特异性，最常见的就是容易疲劳和胃部不适，一般无脾大，发展为肝硬化（E错）后，在肝功能失代偿期可因肝硬化门静脉高压引起脾大，主要是脾静脉回流阻力增加及门静脉压力逆传到脾，使脾脏被动淤血性肿大，脾脏大小、活动度、质地与病程病因有关。